青春期龈炎好发部位是
A. 上颌磨牙颊侧龈缘
B. 上颌磨牙腭侧龈缘
C. 前牙唇侧龈缘和龈乳头
D. 上颌双尖牙颊侧龈缘
E. 下颌双尖牙牙间乳头

正确答案：C。前牙唇侧龈缘和龈乳头

解析：本题考查青春期龈炎的好发部位。青春期龈炎是青春期受内分泌影响在菌斑的作用下发生的牙龈炎，好发于前牙唇侧的牙龈乳头和龈缘（C对）。唇侧牙龈肿胀较明显，龈乳头常呈球状凸起，颜色暗红或鲜红，光亮，质地软，探诊出血。其他选项好发部位无特异性（ABDE错）。